男婴，娩出1分钟时，心率为104次/分，呼吸不规则而且慢，四肢活动好，青紫，弹足底有反应，躯干皮肤粉红，1分钟Apgar评分可评为
A. 9分
B. 8分
C. 7分
D. 6分
E. 5分

正确答案：C。7分